适用于有完整子宫、不希望有月经样出血的绝经期妇女的治疗方案是
A. 阴道应用雌激素
B. 雌、孕激素序贯方案
C. 单孕激素补充方案
D. 单雌激素补充方案
E. 雌、孕激素连续联合方案

正确答案：E。雌、孕激素连续联合方案

解析：本题考查绝经激素治疗。雌、孕激素连续联合方案（E对）适用于有完整子宫、绝经后不希望有月经样出血的妇女。雌、孕激素序贯方案（B错）适用于有完整子宫、围绝经期或绝经后仍希望有月经样出血的妇女。单孕激素补充方案（C错）适用于绝经过渡期早期，调整卵巢功能衰退过程中出现的月经问题。单雌激素补充方案（D错）适用于子宫已切除的妇女，通常连续应用。